患者食欲和记忆力减退。检查：眼睑苍白，血红细胞、白细胞和血小板均减少。应首先考虑的是
A. 再生障碍性贫血
B. 缺铁性贫血
C. 溶血性贫血
D. 失血性贫血
E. 巨幼红细胞性贫血

正确答案：A。再生障碍性贫血

解析：该患者食欲和记忆力减退，检查：眼睑苍白（提示有贫血），血红细胞、白细胞和血小板均减少（即外周全血细胞减少，常是骨髓造血功能衰竭的特征），根据症状及检查应首先考虑的是骨髓造血功能衰竭疾病，再生障碍性贫血（A对）。缺铁性贫血（B错）是造血原料不足所致，主要表现为乏力、易倦、头晕、眼花、心悸、气短、纳差、苍白、精神行为异常、舌乳头萎缩等症状，呈小细胞低色素性贫血、骨髓象示增生活跃或明显活跃，以红系增生为主，不引起白细胞和血小板减少。溶血性贫血（B错）是红细胞破坏过多所致，急性溶血性贫血主要表现为严重的腰背及四肢酸痛，伴头痛、呕吐、寒战，随后高热、面色苍白和血红蛋白尿、黄疸；慢性溶血性贫血临床表现有贫血、黄疸、脾大，不引起白细胞和血小板减少。失血性贫血（D错）红细胞丢失过多所致，不会出现白细胞和血小板减少。巨幼红细胞性贫血（E错）是造血原料不足所致，主要表现为贫血及消化道功能紊乱，“鲜牛肉舌”、食欲减退，共济失调等维生素B12缺乏的神经系统表现；骨髓像示巨幼红细胞增生，并不会导致白细胞和血小板均减少。